毛细血管壁增厚呈车轨状或分层状见于
A. 弥漫性毛细血管内增生性肾小球肾炎
B. 弥漫性系膜增生性肾小球肾炎
C. 弥漫性新月体性肾小球肾炎
D. 弥漫性膜性增生性肾小球肾炎
E. 轻微病变性肾小球肾炎

正确答案：D。弥漫性膜性增生性肾小球肾炎

解析：毛细血管壁增厚呈车轨状或分层状见于弥漫性膜性增生性肾小球肾炎（D对），其组织学特点是肾小球基膜增厚、系膜细胞增生和系膜基质增多，增生的系膜细胞突起插入毛细血管袢中，形成车轨状。弥漫性毛细血管内增生性肾小球肾炎（急性肾炎）（A错）的组织学特点为内皮细胞和系膜细胞增生（P265）。弥漫性系膜增生性肾小球肾炎（B错）的组织学特点为系膜细胞和系膜基质增多（P272）。弥漫性新月体性肾小球肾炎（C错）的组织学特点为新月体形成（P267）。轻微病变性肾小球肾炎（E错）的组织学特点为脏层上皮细胞足突消失（P270）。